下列哪种类型不属于以DNA为靶的诱变
A. 烷化剂作用
B. 碱基类似物取代作用
C. 嵌入剂作用
D. 对DNA合成酶系的破坏作用

正确答案：D。对DNA合成酶系的破坏作用

解析：本题考查以DNA为靶的诱变作用。烷化剂作用（A对）、碱基类似物取代作用（B对）、嵌入剂作用（C对）均属于以DNA为靶的诱变作用。对DNA合成酶系的破坏作用（D错，为本题正确答案）是不以DNA为靶的诱变作用。